将粒子群混悬于溶液中，根据Stokes方程求出粒子粒径的方法属于
A. 显微镜法
B. 沉降法
C. 库尔特记数法
D. 气体吸附法
E. 筛分法

正确答案：B。沉降法

解析：本题考查粒子粒径的检测方法。将粒子群混悬于溶液中，根据Stokes方程求出粒子粒径的方法属于沉降法（B对）。沉降法是根据Stocks方程求出的粒子的粒径的方法，适用于100㎛以下的粒径的测定。库尔特计数法（C错）是将粒子群混悬于电解质溶液中，根据电阻改变求出粒子粒径的方法，本方法可用于混悬剂、乳剂、脂质体、粉末药物等粒径的测定。